男孩，8岁。少尿、肉眼血尿3天。查体：BP130/105mmHg。尿常规：尿蛋白（++），RBC（++++），可能与该患儿发病相关的疾病是
A. 脓皮病
B. 手足口病
C. 肺炎链球菌肺炎
D. 肺炎支原体肺炎
E. 麻疹

正确答案：A。脓皮病

解析：患儿8岁幼童（急性肾炎好发年龄段），急性起病，肉眼血尿伴少量蛋白尿、少尿3天，查体：BP130/105mmHg（2级高血压）。据患者年龄，临床表现和体征最可能的诊断为：急性肾小球肾炎。该病多由A组β溶血性链球菌急性感染引起，以上呼吸道感染或扁桃体炎最常见，脓皮病（A对）或皮肤感染次之。肺炎链球菌（C错）、麻疹病毒（E错）、肺炎支原体（D错）等也可导致急性肾炎，但少见。本题需注意区别乙型溶血性链球菌（即A组β溶血性链球菌）与肺炎链球菌，前者致病性强，多侵犯结缔组织，可引起脓皮病、呼吸道感染，免疫交叉引起变态反应性肾炎，风湿病及心肌炎等；后者多引发大叶性肺炎，不造成组织破坏。